环孢素最常见的不良反应是
A. 肾毒性
B. 肝损害
C. 多毛
D. 继发感染
E. 继发肿瘤

正确答案：A。肾毒性